含糖分多的饮片，应贮存于
A. 阴暗处
B. 密闭容器内
C. 避光凉爽处
D. 通风干燥处
E. 凉暗处

正确答案：D。通风干燥处

解析：本题考查的是中药饮片的贮藏要求。含糖分多的饮片，应贮存于通风干燥处（D对）。对于含不同性质化学成分或用不同炮制方法炮制的饮片，可根据其具体情况，确定不同的贮存方法。例如：1.含淀粉多的药材和饮片，如泽泻、山药、葛根等，应贮于通风、干燥处，以防虫蛀。2.含挥发油多的药材和饮片，如薄荷、当归、川芎、荆芥等，贮藏时室温不可太高，否则容易走失香气或泛油，应置阴凉、干燥处贮存。3.含糖分及黏液质较多的饮片，如肉苁蓉、熟地黄、天冬、党参等，应贮于通风干燥处。4.种子类药材因炒制后增加了香气，如紫苏子、莱菔子、薏苡仁、扁豆等，若包装不坚固则易受虫害及鼠咬，故应密闭贮藏于缸、罐中（B错）。5.动物类药材主要有皮、骨、甲、蛇虫躯体，易生虫和泛油，并且有腥臭气味。应密封保存，四周无鼠洞，并有通风设备，阴凉贮存。6.加酒炮制的当归、常山、大黄等饮片，加醋炮制的芫花、大戟、香附、甘遂等饮片，均应贮于密闭容器中，置阴凉处贮存。7.盐炙的泽泻、知母、车前子、巴戟天等饮片，很容易吸收空气中的湿气而受潮，若温度过高盐分就会从表面析出，故应贮于密闭容器内，置通风干燥处贮存。8.蜜炙的款冬花、甘草、枇杷叶等饮片，易被污染、虫蛀、霉变或鼠咬，通常密闭贮于缸、罐内，并置通风、干燥处贮存，以免吸潮。9.某些矿物类饮片如硼砂、芒硝等，在干燥空气中容易失去结晶水而风化，故应贮于密封的缸、罐中，并置于凉爽处贮存。10.少数贵重饮片如人参、西洋参、麝香、熊胆、西红花、冬虫夏草等，应与一般饮片分开贮藏，专人管理，并注意防虫、防霉，置阴凉、通风、干燥处贮藏。细贵药品中的麝香，应用瓶装密闭，以防香气走失；牛黄宜瓶装，在霉季时放入石灰缸中，以防受潮霉变；人参极易受潮、发霉、虫蛀、泛油、变色，在霉季也应放入石灰箱内贮存等。11.毒性中药应严格按照有关的管理规定办理，设专人负责管理，切不可与一般饮片混贮，以免发生意外事故。12.易燃的硫黄、火硝等，必须按照消防管理要求，贮存在安全地点。在夏天，应防止自燃。引发自燃的原因主要是含油脂的药材，层层堆置重压，中央产生热量散不出，局部温度增高所致。防止药材自燃的方法主要是药材应干燥，空气要流通，堆垛层间不能太高。贮藏要求为阴暗处（A错）、避光凉爽处（C错）或凉暗处（E错）的中药饮片，2022年考试指南未明确说明。